AIDS的临床表现不包括
A. 隐性感染
B. 急性感染期
C. 无症状潜伏期
D. AIDS相关综合征
E. 典型AIDS

正确答案：A。隐性感染

解析：本病潜伏期较长，HIV侵入人体后可分：①急性感染。②无症状感染。③AIDS相关综合征。④免疫缺陷期（典型AIDS）。掌握“人类免疫缺陷病毒”知识点。